Ⅱa型高脂蛋白血症患者，通过实验室血脂检查，其血脂变化应为
A. 甘油三酯↑↑↑胆固醇↑
B. 胆固醇↑↑甘油三酯↑↑
C. 胆固醇↑↑
D. 甘油三酯↑↑
E. 胆固醇↑↑甘油三酯↑↑且电泳出现宽β带

正确答案：C。胆固醇↑↑

解析：血浆脂质水平异常升高，超过正常范围上限称为高脂血症，传统方法将高脂蛋白血症分为六型：Ⅰ型高脂蛋白血症患者血脂变化为甘油三酯↑↑↑胆固醇↑（A错）；Ⅱa型高脂蛋白血症患者血脂变化为胆固醇↑↑（C对）；Ⅱb型高脂蛋白血症患者血脂变化为胆固醇↑↑甘油三酯↑↑（B错）；Ⅲ型高脂蛋白血症患者血脂变化为胆固醇↑↑甘油三酯↑↑且电泳出现宽β带（E错）；Ⅳ型高脂蛋白血症患者血脂变化为甘油三酯↑↑（D错）；Ⅴ型高脂蛋白血症患者血脂变化也为甘油三酯↑↑↑胆固醇↑（A错）。